可用于催产和引产的是
A. 甲睾酮
B. 甲羟孕酮
C. 他莫昔芬
D. 麦角生物碱
E. 缩宫素

正确答案：E。缩宫素

解析：本题考查缩宫素的临床应用。缩宫素（E对）是多肽类激素子宫收缩药，可刺激子宫平滑肌收缩，使子宫颈扩张，可用于催产和引产。